苯中毒时，测定尿中酚类含量的意义是
A. 判定肝脏解毒功能
B. 反映肾脏排泄苯代谢物功能
C. 反映近期苯接触水平
D. 慢性苯中毒的评价指标
E. 反映苯酚在体内的蓄积状况

正确答案：C。反映近期苯接触水平

解析：本题考查尿酚的意义。酚类代谢产物可与硫酸盐或葡萄糖醛酸结合后自肾脏排出，在接触苯（C的ABDE错）后，尿酚排出量增加。因此尿中酚类的含量可以较直观的表现出近期机体接触苯的水平。